测定药物重量与同体积基质之比的试验称为
A. 融变时限检查
B. 体外溶出度试验
C. 体外吸收试验
D. 置换价测定
E. 熔点测定

正确答案：D。置换价测定